能增强抗凝血酶Ⅲ（ATⅢ）对凝血因子灭活作用的药物是
A. 维生素B₁₂
B. 香豆素类
C. 阿司匹林
D. 维生素K
E. 肝素

正确答案：E。肝素